运用脓肿一次性切开法治疗肛痈，与分次手术最主要的区别是
A. 切口呈放射状
B. 切口长度与脓肿等长
C. 将内口组织切开并搔刮清除
D. 分开脓腔的纤维间隔
E. 术后常规换药

正确答案：C。将内口组织切开并搔刮清除

解析：肛痈常用的手术方法为脓肿一次性切开法、一次切开挂线法和分次手术法。其中脓肿一次性切开法，即在腰俞穴麻醉或局麻下，取截石位，局部消毒，于脓肿处切口，切口呈放射状，长度应与脓肿等长，使引流通畅，同时寻找齿线处感染的肛隐窝或内口，将切口与内口之间的组织切开，并搔刮清除，以避免形成肛漏。分次手术是切口应在压痛或波动明显部位，尽可能靠近肛门，切口呈弧状或放射状，须有足够长度，用红油膏纱布条引流，以保持引流通畅；待形成肛漏后，再按肛漏处理；病变炎症局限和全身情况良好者，如发现内口，可采用切开挂线法，以免二次手术。故脓肿一次性切开法与分次手术最主要的区别是：脓肿一次性切开法会将内口组织切开并搔刮清除干净，防止肛漏（C对）。